8岁男孩，浮肿，尿色红2天入院，查体：颜面眼睑浮肿，心肺听诊无异常，尿常规有红细胞（+++），蛋白（+），患儿半月前患过扁桃体炎。若患儿在病程中出现呼吸增快，心率增快，奔马律，双肺布满中、小水泡音，肝大，BP120/80mmHg。发生上述情况，首先应采取的措施是
A. 使用降压药物
B. 加强抗生素的运用
C. 使用呋塞米（速尿）
D. 补充氯化钠
E. 血液透析

正确答案：C。使用呋塞米（速尿）

解析：8岁男孩，浮肿，尿色红2天入院，查体：颜面眼睑浮肿，心肺听诊无异常，尿常规有红细胞（+++），蛋白（+），患儿半月前患过扁桃体炎等表现提示该患儿可能患有急性肾小球肾炎，而患儿在病程中出现呼吸增快，心率增快，奔马律，双肺布满中、小水泡音，肝大，BP120/80mmHg等表现符合急性肾炎严重表现之严重循环充血，如呼吸困难、端坐呼吸、颈静脉怒张、频咳、咳粉红色泡沫痰、两肺满布湿啰音、心脏扩大，甚至出现奔马率等，发生上述情况，首先应采取纠正水钠潴留，恢复正常血容量，可使用呋塞米注射（C对）。使用降压药物（A错）常用于高血压的治疗，加强抗生素的运用（B错）常用于控制感染，补充氯化钠（D错）常用于纠正低钠血症，血液透析（E错）常用于肾衰的治疗。